口腔癌预防的含义不包括
A. 预防发生
B. 预防对临近组织的损害
C. 预防转移
D. 预防因口腔癌丧失生命
E. 少吃糖多吃含矿物质的食品

正确答案：E。少吃糖多吃含矿物质的食品

解析：口腔癌预防的含义包括预防口腔癌的发生，预防口腔癌对邻近组织的损害，预防口腔癌的转移，预防因口腔癌丧失生命。掌握“口腔癌的预防”知识点。